对原发性慢性肾上腺皮质功能减退症的诊断最有意义的血检结果是
A. 醛固酮↓
B. 血糖↓
C. 血钠↓
D. 皮质醇↓
E. ACTH↓

正确答案：D。皮质醇↓

解析：原发性慢性肾上腺皮质功能减退症由于双侧肾上腺绝大部分被毁引起肾上腺皮质分泌皮质醇减少而产生一系列临床表现，因此对于此病的诊断最有意义的血检结果为血皮质醇降低（D对）。虽然醛固酮亦可减少（A错），但大多数以皮质醇分泌不足为主，且皮质醇降低更具诊断意义。血糖降低（B错）及低钠血症（C错）均无特异性。由于皮质醇和醛固酮的减少，对ACTH（促肾上腺皮质激素）的负反馈性抑制作用减弱，ACTH增加（E错）。